关于HBV抗原-抗体的检测，哪项错误
A. 用于乙型肝炎的诊断
B. 用于筛选合格的献血员
C. 选择治疗用药的参考
D. 判断乙型肝炎的预后
E. 调查人群的免疫水平

正确答案：C。选择治疗用药的参考